以下关于浆液性腺泡的叙述，不正确的是
A. 呈球形，由黏液细胞组成
B. 胞核为圆形，位于基底部1/3处
C. 细胞呈锥体形，基底部较宽
D. 可分泌酶原颗粒
E. 浆液细胞主要表达α-淀粉酶

正确答案：A。呈球形，由黏液细胞组成

解析：浆液性腺泡呈球形，由浆液细胞组成，细胞呈锥体形，基底部较宽，紧附于基底膜上，顶端向着腔内。胞核为圆形，位于基底部1/3处。胞质色深，组织固定好时，顶端胞质内可见大量折光性很强的分泌颗粒，称酶原颗粒。浆液细胞主要表达α-淀粉酶。掌握“唾液腺组织结构”知识点。